炎症的本质主要是
A. 以损伤为主的反应
B. 局部组织发生变质、渗出、增生
C. 局部组织的血管反应
D. 局部出现红肿热痛和功能障碍
E. 以防御为主的病理过程

正确答案：E。以防御为主的病理过程

解析：炎症的本质主要是具有血管系统的活体组织对各种损伤因子的刺激所发生的以防御为主的病理过程（E对A错）。局部组织发生变质、渗出和增生（B错）是炎症的基本病理变化（P64）。局部出现红、肿、热、痛和功能障碍（D错）是炎症的局部表现（P65）。局部组织的血管反应（C错）是急性炎症（P66）的主要反应。